男，15岁。因发热、乏力、刷牙时牙龈出血1周入院。查体：T38.5℃，牙龈肿胀，胸骨压痛（+），双下肢小腿出现散在出血点及瘀斑。血常规：Hb80g/L，WBC10.1×10⁹/L，Plt30×10⁹/L；骨髓增生极度活跃，原始细胞占0.60，POX染色呈弱阳性，非特异性酯酶染色阳性，可被NaF抑制，该患者原始细胞最可能的免疫表型是
A. CD14⁺
B. CD41⁺
C. CD8⁺
D. CD3⁺
E. CD4⁺

正确答案：A。CD14⁺

解析：患者青少年男性，发热、乏力、刷牙时牙龈出血1周，查体：T38.5℃，双下肢小腿出现散在出血点及瘀斑，提示出血（贫血、发热、出血是急性白血病正常骨髓造血功能受抑制的表现），牙龈肿胀，胸骨压痛（+）（急性白血病细胞浸润可引起牙龈肿胀，胸骨压痛，前者尤以M₄、M₅多见），血常规：Hb80g/L，提示贫血，WBC10.1×10⁹/L（正常4～10×10⁹/L），Plt30×10⁹/L（正常100～300×10⁹/L）减少，骨髓增生极度活跃，原始细胞占0.60（骨髓原始细胞≥30%（FAB分型）或≥20%（WHO分型）即可诊断为急性白血病），POX染色呈弱阳性（见于急性单核细胞白血病和分化差的急性粒细胞白血病），非特异性酯酶染色阳性，可被NaF抑制（仅见于急性单核细胞白血病），故考虑患者为急性单核细胞白血病，单核细胞的免疫标记为CD13⁺、CD14⁺（A对）、CD15⁺、CD64⁺。CD41⁺（B错）为巨核细胞免疫标记；CD8⁺（C错）、CD3⁺（D错）、CD4⁺（E错）为T细胞的免疫标记。